男，42岁。风湿性心脏病二尖瓣狭窄合并心房颤动半年余。现口服地高辛0.25mg/天，活动后心悸。心电图示：心室率约130次/分。控制心律失常最宜采取的措施是
A. 加用胺碘酮
B. 地高辛加量至0.5mg/天
C. 加用索他洛尔
D. 加用普罗帕酮
E. 加用美托洛尔

正确答案：E。加用美托洛尔

解析：患者风湿性心脏病二尖瓣狭窄合并房颤动，服地高辛后，心室率约130次/分，控制心律失常最宜采取的措施是加用美托洛尔（选择性β1受体拮抗剂）（E对）。IA（奎尼丁、普鲁卡因胺）、IC（普罗帕酮）（D错）或Ⅲ类（胺碘酮）（A错）抗心律失常药物用于转复房颤并维持窦性心律。索他洛尔（C错）是具有Ⅲ类抗心律失常药物延长动作电位时程兼有β₁、β₂受体阻滞作用的广谱抗心律失常药物，对室上性、室性心律失常均有较好的疗效。